治疗典型失神发作的首选药物是
A. 托吡酯
B. 卡马西平
C. 丙戊酸钠
D. 左乙拉西坦
E. 氯硝西泮

正确答案：C。丙戊酸钠

解析：失神发作分典型和不典型失神发作，典型失神发作的首选药物为丙戊酸钠（C对）。托吡酯（A错）可用于偏头痛的预防性治疗，也可作为新型抗癫痫药物，用于难治性部分性发作及继发全面强直-阵挛发作的附加或单药治疗（P315）。卡马西平（B错）是部分性发作的首选，可加重失神和肌阵挛发作（P314）。左乙拉西坦（D错）为新型抗癫痫药，用于治疗部分性发作伴或不伴继发全面强直-阵挛发作的治疗（P315）。氯硝西泮（E错）常用作辅助用药（P315）。